矽肺诊断所必备的条件是
A. 确切的二氧化硅粉尘接触史
B. 确凿的X线胸片表现
C. 动态观察资料和该单位的矽肺流行病学调查情况
D. 确切的二氧化硅粉尘接触史；确凿的X线胸片表现；动态观察资料和该单位的矽肺流行病学调查情况
E. 肺组织活检

正确答案：D。确切的二氧化硅粉尘接触史；确凿的X线胸片表现；动态观察资料和该单位的矽肺流行病学调查情况

解析：本题考查的是矽肺的诊断标准。矽肺的诊断有明确的标准，首先要求有生产性粉尘接触史、现场劳动卫生学调查资料，同时要以X线胸片或数字化摄影（DR）后前位胸片表现作为主要依据，结合工作场所职业卫生学、尘肺流行病学调查资料和职业健康监护资料，参考临床表现和实验室检查，排除其他肺部类似疾病后，对照尘肺诊断标准片作出尘肺病的诊断和X线分期。职业病的诊断有着严格的要求，每一步都满足条件才能诊断为矽肺（D对ABCE错）。